痫病的病机是
A. 气郁化火，痰火扰心
B. 阳明热盛，扰乱神明
C. 肝风挟痰，蒙蔽清窍
D. 痰气郁结，蒙蔽心神
E. 温病邪热入于心包

正确答案：C。肝风挟痰，蒙蔽清窍

解析：猝然昏仆多与先天禀赋因素有关，因肝风夹痰，蒙蔽清窍所致，常见于痫病（C对）。狂言多因情志不遂，气郁化火，痰火互结，内扰神明所致，多见于狂病、伤寒蓄血证等（A错）。阳明经证表现为邪热蒸腾，扰动心神，心神不宁，故见面赤，心烦；阳明腑证表现为邪热炽盛，上扰心神，轻则不得眠，重则见谵语，甚至狂乱不宁（B错）。淡漠痴呆表现为神识痴呆，表情淡漠，喃喃自语，哭笑无常。多因痰气郁结，蒙蔽心神，常见于癫病或痴呆等（D错）。温热病邪热入心包，常见于各型脑炎、中毒性痢疾、中暑等急性热病的极期（E错）。